心身疾病是
A. 心理社会因素在发病、发展过程中起重要作用的躯体器质性疾病
B. 由心理社会因素引起的精神疾病
C. 由心理社会因素引起的器官系统的功能性改变
D. 由心理社会因素引起的神经症
E. 由心理社会因素引起的生理反应

正确答案：A。心理社会因素在发病、发展过程中起重要作用的躯体器质性疾病

解析：心身疾病是心理社会因素在发病、发展过程中起重要作用的躯体器质性疾病。掌握“心身疾病”知识点。